阴亏血少，心火偏旺而失眠多梦心悸怔忡神疲健忘者治宜选用
A. 天王补心丹
B. 酸枣仁汤
C. 磁朱丸
D. 甘麦大枣汤
E. 朱砂安神丸

正确答案：A。天王补心丹

解析：阴亏血少，心火偏旺而失眠多梦心悸怔忡神疲健忘当予以滋阴养血，补心安神，宜选天王补心丹（A对）--方中重用甘寒之生地黄，入心能养血，入肾能滋阴，故能滋阴养血，壮水以制虚火，为君药。天冬、麦冬滋阴清热，酸枣仁、柏子仁养心安神，当归补血润燥，共助生地滋阴补血，并养心安神，俱为臣药。玄参滋阴降火；茯苓、远志养心安神；人参补气以生血，并能安神益智；五味子之酸以敛心气，安心神；丹参清心活血，合补血药使补而不滞，则心血易生；朱砂镇心安神，以治其标，以上共为佐药。桔梗为舟楫，载药上行以使药力缓留于上部心经，为使药。酸枣仁汤功用为养血安神，清热除烦，主治肝血不足，虚热内扰之虚烦不眠证（B错）。磁朱丸功用为重镇安神，交通心肾，主治心肾不交证（C错）。甘麦大枣汤功用为养心安神，和中缓急，主治脏燥（D错）。朱砂安神丸功用为镇心安神，清热养血，主治心火亢盛，阴血不足证（E错）。